不是细菌耐药性机制的是
A. 产生灭活酶
B. 靶位的修饰和变化
C. 降低外膜的通透性
D. 加强主动流出系统
E. 增加胞浆膜的通透性

正确答案：E。增加胞浆膜的通透性

解析：细菌耐药性产生的机制主要有∶1.产生灭活酶（A对）2.改变抗菌药物作用靶位（B对）3.降低外膜的通透性（C对）4.加强主动流出系统（D对）第十版药理学（E错，为本题正确答案）。